蜘蛛痣不应出现的部位是
A. 手背
B. 前胸
C. 面部
D. 腹部
E. 颈部

正确答案：D。腹部

解析：皮肤小动脉末端分支性扩张所形成的血管痣，形似蜘蛛，称为蜘蛛痣。多出现于上腔静脉分布的区域，如面部（C对）、颈部（E对）、手背（A对）、上臂、前胸（B对）和肩部等处，大小不等。腹部（D错，为本题正确答案）无上腔静脉分布，故蜘蛛痣不应出现在腹部。